患者男性，50岁，心绞痛病史半年，近1周轻度活动即发作，疼痛程度加重，每次发作持续时间约20分钟，心电图显示ST段下移，T波倒置。应首先考虑的诊断是
A. 变异型心绞痛
B. 恶化型劳累性心绞痛
C. 急性心肌梗死
D. 稳定型劳累性心绞痛
E. 初发型劳累性心绞痛

正确答案：B。恶化型劳累性心绞痛

解析：患者有心绞痛病史半年（存在基础病），胸痛持续时间延长（发作持续时间约20分钟），诱发心绞痛的活动阈值明显减低（轻度活动即发作），按CCS劳力性心绞痛分级加重一级以上并至少达到Ⅲ级（患者疼痛程度加重）。心电图显示ST段下移，T波倒置为心绞痛表现，故诊断为恶化型劳累性心绞痛（B对）。变异型心绞痛：休息或一般活动时发生的心绞痛，发作时心电图显示ST段暂时性抬高（A错）。急性心肌梗死：疼痛较心绞痛更剧烈，持续时间可达半小时，常伴有休克、心律失常及心力衰竭，含服硝酸甘油多不能使之缓解。心电图中面向梗死部位的导联ST段抬高，并有病理性Q波。实验室查示血清心肌酶、肌红蛋白、肌钙蛋白I或T等增高。（C错）。稳定型劳累性心绞痛：心绞痛由体力活动、情绪激动或其他足以增加心肌耗氧量的情况诱发，休息或舌下含服硝酸甘油可迅速缓解。心绞痛发作的性质在1个月以上无改变，即疼痛发作频率大致相同，疼痛的部位、性质、诱因的程度、持续时间、缓解方式无明显改变（D错）。初发型劳累性心绞痛：病程在1个月内新发的心绞痛（从无心绞痛或有心绞痛病史但在近半年内未发作过）（E错）。